病人因急性弥漫性腹膜炎需急症手术，正确的原则和步骤不包括
A. 关腹前在腹腔内用抗生素控制感染
B. 术后一般放置腹腔引流
C. 寻找引起腹膜炎的原发灶
D. 根据怀疑病变脏器的部位确定手术切口
E. 用生理盐水冲洗腹腔至清洁

正确答案：A。关腹前在腹腔内用抗生素控制感染

解析：在腹腔内直接使用抗生素会导致严重的黏连，产生更多的并发症，所以一般腹腔手术关腹前不应用抗生素（A错，为本题正确答案）。引流为一般腹腔手术采用的控制感染的措施（B对）。急性腹膜炎的处理主要在于处理它的原发病，所以应当根据怀疑病变脏器的部位，确定手术切口（D对），并寻找腹膜炎的原发灶（C对），如不能确定原发病变源于哪个脏器，则以右旁正中切口为好，开腹后可向上下延长。开腹后，应当清洁腹腔的浓液和渗出液，清除食物残渣，粪便等异物，可以用生理盐水清理（E对）。